均衡性的目的在于
A. 保证样本的代表性
B. 保证两组之间的可比性
C. 可避免来自病人和医生两方面的偏倚
D. 消除病人的主观选择研究条件对结果的影响
E. 检验两组的可比性

正确答案：E。检验两组的可比性

解析：本题考查均衡性检验的目的。均衡性检验即比较病例组与对照组某些基本特征是否相似或齐同，目的是检验两组的可比性（E对ABCD错）。如果两组在某些基本特征方面的差异有统计学意义，则在推断性分析时应考虑到其对研究结果的可能影响并加以控制。